药品作为特殊药品，其特殊性之一是具有两重性，而两重性主要体现在
A. 功能主治
B. 针对性
C. 药品质量
D. 用药后果
E. 诊断治疗

正确答案：D。用药后果

解析：药品作为特殊药品，其特殊性之一是具有两重性，而两重性主要体现在用药后果。药物具有两重性是指，药物具有治疗作用和不良反应。治疗作用是指药物治疗所引起的符合治疗目的的作用，是有利于防病、治病的作用。不良反应是指不符合用药治疗目的并给病人带来不适或痛苦的反应（D对）。